葡萄糖可在眼用液体制剂中用作
A. pH值调节剂
B. 黏度调节剂
C. 渗透压调节剂
D. 抑菌剂
E. 增溶剂

正确答案：C。渗透压调节剂

解析：本题考查的是眼用液体制剂的附加剂。葡萄糖可在眼用液体制剂中用作渗透压调节剂（C对）。眼用制剂的附加剂有：（1）渗透压调节剂：除另有规定外，水溶性滴眼剂、洗眼剂和眼用注射溶液应与泪液等渗。洗眼剂属于用量较大的眼用制剂，也应尽可能与泪液等渗。常用渗透压调节剂有氯化钠、硼酸、葡萄糖、硼砂等。（2）pH调节剂（A错）：洗眼剂应与泪液有相近的pH，常用的pH调节剂有磷酸盐缓冲液、硼酸盐缓冲液等。（3）抑菌剂（D错）：多剂量眼用制剂，应加适当抑菌剂。常用抑菌剂有三氯叔丁醇、硝酸苯汞、苯乙醇、羟苯乙酯等。（4）黏度调节剂（B错）：适当增加滴眼剂的黏度，可减少刺激性，延缓混悬型眼用制剂沉降、延长药液在眼内滞留时间，增强药效。常用的黏度调节剂有甲基纤维素、聚乙烯醇、聚维酮等。（5）其他附加剂：根据药物性质和制备要求，还可加入增溶剂（E错）、助溶剂、抗氧剂等。